提示与习惯性流产有相关性的检查是
A. 抗着丝点抗体
B. 抗磷脂抗体
C. 抗RNP抗体
D. 抗组蛋白抗体
E. 抗中性粒细胞胞浆抗体

正确答案：B。抗磷脂抗体

解析：抗磷脂抗体能引起患者血栓形成、血小板减少及自身免疫功能异常，最终导致习惯性流产，故提示与习惯性流产有相关性的检查是抗磷脂抗体（B对）。抗着丝点抗体（A错）与系统硬化症有关。抗RNP抗体（C错）与混合结缔组织病有关。抗组蛋白抗体（D错）与类风湿关节炎有关。抗中性粒细胞胞浆抗体（E错）与血管炎有关。